下列钙拮抗药中，主要用于治疗脑血管病的药物是
A. 维拉帕米
B. 硝苯地平
C. 地尔硫䓬
D. 普尼拉明
E. 尼莫地平

正确答案：E。尼莫地平

解析：血管平滑肌的肌浆网的发育较差，血管收缩时所需要的Ca²⁺主要来自细胞外，故血管平滑肌对钙通道阻滞剂很敏感，其中对脑血管具有较强扩张作用的钙拮抗药是尼莫地平（E对），可选择性舒张脑血管平滑肌，明显减轻脑血管痉挛，增加脑血流量，改善脑组织的血液循环，其脂溶性好，可有效的治疗脑血管痉挛、脑缺血（尤其脑卒中早期使用）及蛛网膜下隙出血。维拉帕米（A错）是室上速的首选药。硝苯地平（B错）是变异性心绞痛首选药、抗高血压、抗心力衰竭。地尔硫䓬（C错）主要用于抗高血压、抗心绞痛、抗心律失常、治疗肥厚性心肌病。普尼拉明（D错）主要用于心绞痛、心肌梗死室性期前收缩等。